男孩，5岁。患有结核病，但结核菌素试验阴性。可见于
A. 合并上呼吸道感染
B. 抗结核治疗1周
C. 接种白百破三联疫苗后
D. 粟粒型肺结核
E. 颈部淋巴结结核

正确答案：D。粟粒型肺结核

解析：该男童患有结核病，但结核菌素试验阴性，考虑为假阴性反应。假阴性反应多见于机体免疫功能低下或受抑制，如粟粒性肺结核（D对）及结核性脑膜炎等危重结核病；体质极度衰弱；急性传染病如麻疹、水痘等；应用糖皮质激素或其他免疫抑制剂治疗时；原发或继发免疫缺陷病。